男性，65岁。近2年来右上肢抖动，动作迟缓面容呆板，行走起步困难，查体右上下肢肌张力增高，齿轮样动作。最不应给的药物是
A. 苯海拉明
B. 阿普唑仑
C. 苯海索
D. 氯丙嗪
E. 尼莫地平

正确答案：D。氯丙嗪